关于脂肪酸β-氧化的叙述错误的是
A. 酶系存在于线粒体中
B. 不发生脱水反应
C. 需要FAD及NAD⁺为受氢体
D. 脂肪酸的活化是必要的步骤
E. 每进行一次β-氧化产生2分子乙酰CoA

正确答案：E。每进行一次β-氧化产生2分子乙酰CoA

解析：脂肪酸分解代谢前必须在胞液中活化成脂酰CoA（D对），然后进入线粒体中，在线粒体中酶的作用下（A对），进行脱氢、加水、再脱氢及硫解四步反应（B对），其中FAD及NAD⁺为脱氢反应的受氢体（C对），最后生成少2个碳原子的脂酰CoA及1分子乙酰CoA（E错，为本题正确答案）。